青春期下丘脑分泌促性腺激素释放激素的作用是
A. 刺激卵巢发育及排卵
B. 刺激垂体分泌雌激素与孕激素
C. 刺激子宫发育、内膜增厚、月经来潮
D. 刺激垂体分泌促卵泡素（FSH）及黄体生成素（LH）
E. 刺激卵巢分泌促卵泡素（FSH）及黄体生成素（LH）

正确答案：D。刺激垂体分泌促卵泡素（FSH）及黄体生成素（LH）

解析：本题考查青春期下丘脑分泌促性腺激素释放激素的作用。青春期开始后，下丘脑分泌促性腺激素释放激素的反应性增强，刺激垂体分泌出更多的促卵泡素（FSH）及黄体生成素（LH）（D对ABCE错），对女孩卵巢的发育成熟起了十分重要的作用。到青春中、晚期，随着卵巢的发育成熟，血中促卵泡素（FSH）、黄体生成素（LH）及雌激素、孕酮的浓度逐渐接近青年女子月经周期的典型变化。在卵巢激素的影响下，少女的性发育逐渐成熟。